妇女痛经，经血紫暗有块，胸胁胀满疼痛，其证是
A. 气血两虚证
B. 气不摄血证
C. 气虚血瘀证
D. 气随血脱证
E. 气滞血瘀证

正确答案：E。气滞血瘀证

解析：气滞血瘀证的证候表现为局部胀闷走窜疼痛，甚或刺痛，疼痛固定、拒按；或有肿块坚硬，局部青紫肿胀；或有情志抑郁，急躁易怒；或有面色紫暗，皮肤青筋暴露；妇女可见经行不畅，经色紫暗或夹血块，经闭或痛经（E对）；舌质紫暗或有紫斑、紫点，脉弦涩。气血两虚证的证候表现为神疲乏力，少气懒言，自汗，面色淡白或萎黄，口唇、眼睑、爪甲颜色淡白，头晕目眩，心悸失眠，形体消瘦，肢体麻木，月经量少色淡，愆期甚或闭经，舌质淡白，脉弱或虚（A错）。气不摄血证的证候表现为鼻衄、齿衄、皮下紫斑、吐血、便血、尿血、月经过多、崩漏等各种出血，面色淡白无华，神疲乏力，少气懒言，心悸失眠，舌淡白脉弱（B错）。气虚血瘀证的证候表现为面色淡白或面色暗滞，倦怠乏力，少气懒言，胸胁或其他部位疼痛如刺，痛处固定不移、拒按，舌淡暗或有紫斑、紫点，脉涩（C错）。气随血脱证的证候表现为大量出血时，突然而色苍白，气少息微，大汗淋漓，手足厥冷，甚至晕厥，或舌淡，脉微或芤或散（D错）。